典型伤寒的临床表现不包括
A. 脾大
B. 相对缓脉
C. 表情淡漠
D. 持续发热
E. 出血性皮疹

正确答案：E。出血性皮疹

解析：大约一半以上的患者在病程7到14天，可出现淡红色的小斑丘疹，称为玫瑰疹，直径2到4毫米，压之褪色，一般在2到4天内变暗淡消失，可分批出现。伤寒的玫瑰疹为小斑丘疹，并非出血性皮疹（E错，为正确答案）（P150）。伤寒沙门菌释放脂多糖内毒素可激活单核吞噬细胞释放白细胞介素-1和肿瘤坏死因子等细胞因子，引起持续发热（D对），表情淡漠（C对），相对缓脉（B对），休克和白细胞减少等表现（P150）。